解磷定治疗有机磷中毒的机制
A. 使胆碱酯酶恢复活性，消除或减轻烟碱样症状
B. 解除有机磷中毒的毒蕈碱样症状
C. 与有机磷结合排除体外
D. 使有机磷氧化还原成无毒物质
E. 以上都不是

正确答案：A。使胆碱酯酶恢复活性，消除或减轻烟碱样症状